女，40岁。反复手关节痛1年，曾诊断为类风湿关节炎，间断使用理疗和非甾体抗炎药，症状有缓解。近月来低热，关节痛加重，肘后出现多个皮下结节，检查ESR40mm/h，心脏彩超发现小量心包积液，考虑为类风湿关节炎活动。最适宜的治疗措施是
A. 维持原治疗方案
B. 改用皮质激素
C. 加用青霉素
D. 选用慢作用抗风湿药
E. 应用皮质激素加慢作用抗风湿药

正确答案：E。应用皮质激素加慢作用抗风湿药

解析：类风湿关节炎有心包积液提示患者出现系统症状，心脏受累，此时应使用糖皮质激素迅速控制症状，减轻炎症反应。使用糖皮质激素必须同时应用改善病情抗风湿药，有改善和延缓病情进展的作用，但其发挥作用慢，临床症状的明显改善大约需要1～6个月，患者处于类风湿关节炎活动，需要快速控制症状，不适合单用抗风湿药（D错），而单用糖皮质激素（B错）能迅速缓解关节肿痛症状和全身炎症，但不能根治本病，长期应用时不良反应较多，且停药易复发，故最适宜的治疗措施是应用皮质激素加慢作用抗风湿药（E对）。维持原治疗方案（A错）即继续使用理疗和非甾体类抗炎药，仅可治疗关节痛，对于心包积液无效。加用青霉素（C错）无意义。